社会阶层的含义包括
A. 文化水平、职业
B. 经济地位、文化水平
C. 经济地位、文化水平、职业
D. 经济地位、文化水平、职业、价值观念
E. 经济地位、文化水平、职业、价值观念和生活条件等

正确答案：E。经济地位、文化水平、职业、价值观念和生活条件等